急性心肌梗死溶栓治疗中最常用的溶栓剂是
A. 肝素
B. 尿激酶
C. 去纤酶
D. 蝮蛇抗栓酶
E. 阿司匹林

正确答案：B。尿激酶

解析：急性心肌梗死溶栓治疗中最常用的溶栓剂是尿激酶（B对）、链激酶和重组组织型纤维蛋白溶酶原激活剂等。其作用原理是激活血栓中纤维蛋白溶酶原，使转变为纤维蛋白溶酶而溶解冠状动脉内的血栓。肝素（P242）（A错）为抗凝药物，对溶栓治疗的患者，可作为溶栓治疗的辅助用药。去纤酶（C错）是从蛇毒中提取的一种物质，能溶解血浆纤维蛋白原和纤维蛋白，故能溶解血栓。对冠心病、心绞痛、心肌梗死也有一定疗效。蝮蛇抗栓酶（D错）系从蝮蛇蛇毒中分离出的酶制剂，能降低血液中纤维蛋白原浓度，降低血液粘度，减少血小板数量，并抑制其功能。用于治疗深部静脉血栓，亦用于脑血栓、心肌梗死等症。但两者并非急性心肌梗死患者临床溶栓的常用药物。阿司匹林（P242）（E错）为抗血小板聚集的药物，并非溶栓剂。